人类轮状病毒可分为7个组（A～G），被称为婴儿腹泻轮状病毒的是
A. A组
B. B组
C. C组
D. D组
E. E组

正确答案：A。A组